严重缺氧导致细胞损伤时，细胞膜内外的离子浓度变化为
A. 细胞外K+减少
B. 细胞内Na+和Ca2+增多
C. 细胞内Ca2+减少
D. 细胞外H+减少
E. 细胞内Na+减少

正确答案：B。细胞内Na+和Ca2+增多

解析：缺氧时可以引起细胞膜的损伤。缺氧时ATP生成减少，细胞膜上Na+-K+-ATP酶功能降低，加上缺氧时细胞内乳酸增多，PH降低（D错），使细胞膜的通透性升高，由于细胞内外Na+、K+分布的特点，Na+内流，K+外流，从而使细胞内Na+增多（B对E错），细胞外K+增多（A错）。同时缺氧时细胞膜对Ca2+的通透性增高，ATP的减少使细胞膜钙泵和肌浆网对Ca2+的摄取减少，使细胞内Ca2+增多（C错）。